下列疾病治疗后最易继发肛瘘的是
A. 肛周脓肿
B. 外痔
C. 肛裂
D. 混合痔
E. 内痔

正确答案：A。肛周脓肿

解析：肛瘘是指肛管周围的肉芽肿性管道，由内口、瘘管、外口三部分组成，大部分由肛周脓肿（A对）引起，结核、溃疡性结肠炎、克罗恩病等特异性炎症、恶性肿瘤、肛管外伤感染也可引起肛瘘，但较为少见。